低渗性脱水对机体最主要的影响是
A. 酸中毒
B. 氮质血症
C. 循环衰竭
D. 脑出血
E. 神经系统功能障碍

正确答案：C。循环衰竭

解析：低渗性脱水时由于细胞外液渗透压降低，细胞外液向渗透压相对较高的细胞内转移，导致细胞外液明显减少，血容量不足而出现循环衰竭（C对）。低渗性脱水可因醛固酮分泌增多，细胞外钾离子减少，细胞内氢离子转移致细胞外以维持体液的离子平衡而合并酸中毒（A错）。循环血量减少致肾血流量减少，尿量减少而出现氮质血症（B错）。神经系统功能障碍（E错）在重度低渗性缺水（血钠浓度＜120mmol/L）时出现。低渗性脱水无脑出血（D错）表现。